环磷酰胺对何种肿瘤疗效最为显著
A. 卵巢癌
B. 急性淋巴细胞性白血病
C. 肺癌
D. 多发性骨髄瘤
E. 恶性淋巴瘤

正确答案：E。恶性淋巴瘤

解析：环磷酰胺抗瘤谱较广，对恶性淋巴瘤疗效最为显著（E对），对多发性骨髓瘤（D错）、急性淋巴细胞白血病（B错）、肺癌（C错）、乳腺癌、卵巢癌（A错）、神经母细胞瘤和睾丸瘤等均有一定的疗效，但不是最为显著的。